速发型硅沉着病是指从事矽尘作业多长时间出现的硅沉着病
A. 半年
B. 1～2年
C. 5年
D. 5～10年
E. ＜1年

正确答案：B。1～2年